不符合妄想特征的是
A. 内容与客观现实不符合
B. 是一种病理的信念
C. 内容多与患者自身相关
D. 内容受文化背景影响
E. 受教育越高越容易出现妄想

正确答案：E。受教育越高越容易出现妄想